属于人工被动免疫的制品是
A. 卡介苗
B. 脊髓灰质炎疫苗
C. 麻疹疫苗
D. 白喉类毒素
E. 白喉抗毒素

正确答案：E。白喉抗毒素

解析：本题考查人工被动免疫。人工被动免疫是将含有特异性抗体的血清或制剂接种人体，使机体被动地获得特异性免疫力而受到保护。属于人工被动免疫的制品是白喉抗毒素（E对ABCD错）。